红细胞葡萄糖-6-磷酸脱氢酶缺陷症
A. 红细胞脆性增加
B. 红细胞脆性降低
C. 红细胞酶缺陷
D. 血清铁蛋白减少
E. Coomb's试验

正确答案：C。红细胞酶缺陷

解析：本题考查红细胞葡萄糖-6-磷酸脱氢酶缺陷症的相关内容。红细胞葡萄糖-6-磷酸脱氢酶缺陷症的致病机制尚未十分明了。已知有敏感红细胞缺陷（C对ABDE错），因G-6-PD的缺陷不能提供足够的还原型辅酶II（NADPH）以维持还原型谷胱甘肽（GSH）的还原性（抗氧化作用），在遇到蚕豆和某种因子后更诱发了红细胞膜被氧化，产生溶血反应。